小儿遗尿的病变脏腑是
A. 脾、肾
B. 肾、膀胱
C. 心、肾
D. 心、膀胱
E. 肝、肾

正确答案：B。肾、膀胱

解析：该题考查小儿遗尿的病变脏腑。《诸病源候论·小儿杂病诸候·遗尿候》说:“遗尿者，此由膀肤有冷，不能约于水故也…肾主水，肾气下通于阴，小便者，水液之余也，膀胱为津液之腑，既冷气衰弱，不彭约水，故遗尿也。”。历代医家均认为小儿遗尿多系虚寒，小儿遗尿的病变脏腑在膀胱和肾，其中尤以肾气不足，膀胱虚寒为多见（B对）。